在钙超载引起的再灌注损伤中下列哪一项不产生
A. 促进氧自由基生成
B. 破坏细胞骨架
C. 产生内质网功能障碍
D. 激活钙依赖性蛋白酶
E. 产生线粒体功能障碍

正确答案：C。产生内质网功能障碍

解析：钙超载既是缺血－再灌注的结果，又是缺血－再灌注细胞损伤的原因,缺血－再灌注细胞损伤可促进氧自由基生成（A对）。细胞内Ca2+增加可激活磷脂酶类，促使膜磷脂降解，造成细胞膜结构受损。 还可激活钙依赖性蛋白酶（D对）活性，促进细胞膜和结构蛋白的分解；激活核酸内切酶，引起染色体的损伤。缺血－再灌注可使线粒体渗透性转导孔(mPTP)开放，既可产生线粒体功能障碍（E对），又可导致细胞色素C(Cyt C)释放及凋亡蛋白酶激活，启动细胞凋亡途径。缺血－再灌注可使溶酶体膜破裂，溶酶体内蛋白水解酶逸出引起细胞自溶，破坏细胞骨架（B对）。产生内质网功能障碍（C错，为本题正确答案）不在钙超载引起的再灌注损伤中。